乳剂特点的错误表述是
A. 乳剂液滴的分散度大
B. 乳剂中药物吸收快
C. 乳剂的生物利用度高
D. 一般W/O型乳剂专供静脉注射用
E. 静脉注射乳剂注射后分布较快，有靶向性

正确答案：D。一般W/O型乳剂专供静脉注射用